CO中毒引起的昏迷患者，有些在恢复后数周甚至数月后突然发生严重的脑病，属于
A. 迟发性毒性作用
B. 过敏性反应
C. 高敏感性
D. 速发性毒性作用
E. 特异体质反应

正确答案：A。迟发性毒性作用